用于消毒皮肤的洗必泰液浓度为
A. 0.1%
B. 0.5%
C. 1%
D. 2%
E. 3%

正确答案：B。0.5%

解析：本题考查常用消毒药物。0.5％（B对）是用于消毒皮肤的洗必泰液浓度，洗必泰液为广谱消毒剂，刺激性小，故使用广泛。0.1％（A错）用于口腔内及创口消毒的洗必泰液浓度。1％（C错）是用于口腔内及创口消毒的碘酊浓度，2％（D错）是用于颌面颈部消毒的碘酊浓度，3％（E错）是用于头皮部消毒的碘酊浓度，碘酊杀菌力强，但刺激性大，故在不同部位使用浓度不同。